卡马西平的不良反应包括
A. 眩晕
B. 嗜睡
C. 恶心
D. 皮疹
E. 以上都是

正确答案：E。以上都是

解析：不良反应有眩晕、嗜睡、恶心、皮疹、消化障碍、白细胞减少，停药后可恢复正常。掌握“三叉神经痛”知识点。